下列哪个腧穴被首选治疗上肢痉挛瘫痪、前臂神经痛
A. 臂中
B. 肩髃
C. 曲池
D. 合谷
E. 肩臑

正确答案：A。臂中

解析：臂中穴为经外奇穴，在治疗上肢痉挛瘫痪、前臂神经痛时首选臂中穴（A对）。肩髃（B错）主治肩臂挛痛、上肢不遂等肩、上肢病症；瘾疹。曲池（C错）主治手臂痹痛、上肢不遂等上肢病症；热病；眩晕；腹痛、吐泻等肠胃病症；咽喉肿痛、齿痛、目赤肿痛等五官热性病症；瘾疹、湿疹、瘰疬等皮外科疾患；癫狂。合谷（D错）主治头痛、目赤肿痛、齿痛、鼻衄、口眼歪斜、耳聋等头面五官诸疾；发热恶寒等外感病症；热病无汗或多汗；经闭、滞产等妇科病症；牙拔除术、甲状腺手术等口面五官及颈部手术针麻常用穴。臂臑（E错）主治肩臂疼痛不遂、颈项拘挛等肩、颈项病症；瘰疬；目疾。